男，14岁。因腰痛、发热、尿频、尿急、尿痛而求治。检查后诊断为大肠杆菌所致的泌尿系感染，应首选
A. 诺氟沙星
B. 红霉素
C. 青霉素
D. 一代头孢
E. 苯唑西林

正确答案：C。青霉素

解析：患儿14岁，诊断为泌尿系感染，有发热等全身症状，多选用青霉素类、氨基糖苷类或头孢菌素类单独或联合治疗（C对）。诺氟沙星有骨髓抑制作用，不宜用于儿童及孕妇（A错）。红霉素属于大环内酯类抗生素，对脑膜炎奈瑟菌、流感杆菌等高度敏感，一般不用于大肠杆菌感染的泌尿性感染（B错）。一代头孢（D错）、苯唑西林（E错）均为β-内酰胺类抗生素，对G⁻菌作用较弱，一般不用于大肠杆菌治疗。